轴型皮瓣的长宽比例为
A. 1.5:1
B. 1:1
C. 3:1
D. 4:1
E. 无限制

正确答案：E。无限制

解析：本题考查皮瓣移植。轴型皮瓣的长宽比例无限制（E对）。轴型皮瓣：也称动脉皮瓣。它的特点是有一对知名血管供血与回流，因而只要在血管的长轴内设计皮瓣，一般可不受长宽比例的限制。